骨折的专有体征是
A. 血运不良
B. 局部畸形
C. 疼痛与压痛
D. 局部肿胀
E. 功能障碍

正确答案：B。局部畸形

解析：骨折的特有体征包括畸形､异常活动､骨擦音或骨擦感，具有其中体征之一者，即可确诊为骨折(B对）｡